对诊断系统性红斑狼疮最有意义的检查是
A. 免疫球蛋白测定
B. 抗核抗体
C. 总补体溶血活力测定
D. E玫瑰花试验
E. 淋巴细胞转化试验

正确答案：B。抗核抗体

解析：对诊断系统性红斑狼疮最有意义的检查是抗核抗体（B对），抗核抗体几乎见于所有活动期系统性红斑狼疮患者。免疫球蛋白测定（A错）用于检查机体体液免疫功能。总补体溶血活力测定（C错）：增高见于急性炎症、急性组织损伤、恶性肿瘤、妊娠等；降低见于肾小球肾炎等。E玫瑰花试验（D错）是检查细胞免疫的一种方法。淋巴细胞转化试验（E错）可根据淋巴细胞转化情况，反应机体的细胞免疫水平。